关于糖皮质激素外用制剂使用注意事项的说法，错误的是
A. 面部、阴部和皱褶部位的湿疹，需长期使用强效制剂
B. 可用于过敏性皮炎治疗
C. 为控制的细菌或真菌感染不宜使用
D. 若继发细菌或真菌感染，可与抗菌药或抗真菌药联合使用
E. 若使用中出现过敏症状应立即停药

正确答案：A。面部、阴部和皱褶部位的湿疹，需长期使用强效制剂

解析：本题考查糖皮质激素。关于糖皮质激素外用制剂使用注意事项的说法，错误的是面部、阴部和皱褶部位的湿疹，需长期使用强效制剂（A错，为本题正确答案）。外用糖皮质激素不能用于皮肤溃疡或有皮肤萎缩的部位。外用糖皮质激素具有抗炎、抗过敏（B对）、免疫抑制及抗增生等药理作用。外用糖皮质激素不能用于皮肤溃疡或有皮肤萎缩的部位；也不能用于局部有明显细菌、真菌及病毒感染的疾病（C对）。如皮肤合并感染时，应联合应用抗菌药物（D对）。若使用中出现过敏症状应立即停药（E对）。